臀部和会阴的淋巴注入
A. 直肠旁淋巴结
B. 腹股沟浅淋巴结
C. 骶淋巴结
D. 髂内淋巴结
E. 髂外淋巴结

正确答案：B。腹股沟浅淋巴结

解析：腹股沟浅淋巴结（B对）上群引流腹前外侧壁下部、臀部、会阴和子宫底淋巴。